不属于髂内动脉分支的是
A. 卵巢动脉
B. 子宫动脉
C. 膀胱下动脉
D. 阴部内动脉
E. 直肠下动脉

正确答案：A。卵巢动脉

解析：卵巢动脉（A错，为本题正确答案）为腹主动脉的分支。子宫动脉（B对）、膀胱下动脉（C对）、阴部内动脉（D对）、直肠下动脉（E对）均为髂内动脉的分支。